“虚”的病机概念，主要是指
A. 卫气不固
B. 正气虚损
C. 脏腑功能低下
D. 气血生化不足
E. 气化无力

正确答案：B。正气虚损

解析：本题考查“虚”的病机概念，属于理解记忆内容。虚，指正气不足，是以正气虚损为矛盾主要方面的一种病理状态（B对）。